男性，20岁，发热二周，体温38～39℃，检查皮肤散在紫癜，颈部及腋下可触及0.5cm×1.5cm大小淋巴结5～6个，脾肋下3cm，血红蛋白85g/L，白细胞10×10⁹/L，血小板25×10⁹/L。此病人在发烧头痛呕吐第二日作脑脊液检查，最可能的发现为
A. 脑脊液中性粒细胞增高
B. 细菌培养阳性
C. 脑脊液发现结核杆菌
D. 脑脊液蛋白量显著增高、糖定量减低
E. 脑脊液白血病细胞增多

正确答案：E。脑脊液白血病细胞增多

解析：患者考虑并发中枢神经系统白血病，脑脊液检查可有压力升高，白细胞数增加，蛋白质增多，而糖定量减少，涂片中可找到白血病细胞。脑脊液蛋白量显著增高、糖定量减低（D错）还可见于化脓性脑膜炎、结核性脑膜炎，不具有特异性，脑脊液白血病细胞增多（E对）为中枢神经系统白血病特异性的诊断，故最佳答案为E。脑脊液中性粒细胞增高（A错）、细菌培养阳性（B错）是化脓性脑膜炎脑脊液检查的特点；脑脊液发现结核杆菌（C错）是结核性脑膜炎脑脊液检查的特点。